毒物动力学中主要参数包括
A. 生物半减期
B. 血浓度-时间曲线下面积
C. 表观分布容积
D. 生物利用度
E. 以上都是

正确答案：E。以上都是